出现面瘫，感觉与分泌功能障碍减轻，出现耳鸣、眩晕。面神经的损伤部位位于
A. 膝状神经节
B. 鼓索与镫骨肌神经节之间
C. 脑桥与膝状神经节之间
D. 镫骨肌与膝状神经节
E. 茎乳孔以外

正确答案：C。脑桥与膝状神经节之间

解析：根据味觉、听觉及泪液检查结果，还可明确面神经损害部位，从而作出相应的损害定位诊断。脑桥与膝状神经节之间：除面瘫外，感觉与分泌功能障碍一般均较轻；如损害影响听神经时，尚可发生耳鸣、眩晕。掌握“面神经麻痹”知识点。